《中华人民共和国地表水环境质量标准》中集中式生活饮用水水源中邻苯二甲酸二正丁酯和邻苯二甲酸二异辛酯含量的规定，分别为多少mg/L
A. 0.008，0.003
B. 0.003，0.008
C. 0.08，0.03
D. 0.03，0.08
E. 0.008，0.006

正确答案：B。0.003，0.008

解析：本题考查邻苯二甲酸酯类化合物的相关内容。《中华人民共和国地表水环境质量标准》中集中式生活饮用水水源中邻苯二甲酸二正丁酯和邻苯二甲酸二异辛酯含量的规定，分别为0.003mg/L和0.008mg/L（B对ACDE错）。